胃阴虚证的辨证要点是
A. 不思饮食
B. 消谷善饥
C. 饥不欲食
D. 知饥不食
E. 食欲减退

正确答案：A、D。不思饮食；知饥不食

解析：本题考查的是胃阴虚证的临床表现。胃阴虚证的辨证要点是不思饮食（A对）与知饥不食（D对）。胃阴虚证的临床表现，常见口咽发干，多以睡后明显，不思饮食，或知饥不食，并有心烦、低热、大便不调、干呕作呃，舌红少苔或无苔，脉细数。消谷善饥（B错）是胃热（火）证的表现。胃热（火）证的临床表现，常见胃脘灼热而疼痛，烦渴多饮或渴欲冷饮，消谷善饥，牙龈肿痛，口臭，泛酸嘈杂，舌红苔黄，脉滑数。饥不欲食（C错）多因胃阴不足、虚火上扰所致。食欲减退（E错）多是脾胃功能失常的表现。